男，35岁，农民。发热5天，尿少1天，查体：体温37.5℃，面部潮红，结膜充血水肿，腋下可见数个出血点。实验室检查：血WBC19X10⁹/L。有异型淋巴细胞，尿蛋白（3+）.最可能的诊断是：
A. 肾综合征出血热
B. 地方性斑疹伤寒
C. 钩端螺旋体病
D. 败血症
E. 急性肾盂肾炎

正确答案：A。肾综合征出血热

解析：男性患者，35岁，农民（多发人群，接触传染源概率大），发热5天，尿少一天，查体：体温37.5℃（低热），面部潮红，结膜充血水肿（渗出水肿征），腋下可见数个出血点（毛细血管损害征）。实验室检查：血WBC19X10⁹/L，有异型淋巴细胞，尿蛋白（3+），根据患者的病史、症状体征和实验室检查，该患者的诊断考虑为肾综合征出血热（A对）。地方性斑疹伤寒（B错）病原体为莫氏立克次体，潜伏期1-2周，起病急骤，体温多在39℃左右，且50%-80%患者有皮疹出现的时间差异很大，一般皮疹从胸、腹部开始，然后向肩、背及四肢扩散，皮疹也可从四肢扩散到躯干，但是脸和颈部、手掌、足底一般无皮疹。钩端螺旋体病（C错）早期起病急表现为发热（39℃左右）和全身中毒，中晚期为器官损伤期（可表现为肺损伤、肝损伤或肾损伤）。败血症（D错）常有寒战，高热，皮疹常为瘀点、多分布于躯干、四肢、口腔黏膜等处数量少。急性肾盂肾炎（E错）发热体温多在38℃可有尿频、尿急、尿痛，体格检查时可有肋脊角或输尿管点压痛和（或）肾区叩击痛。